肋隔隐窝
A. 由壁胸膜与脏胸膜形成
B. 由肋胸膜与膈胸膜反折形成
C. 当深吸气时，该间隙被肺填充
D. 只存在于右侧胸膜腔
E. 是胸膜腔位置最高的部位

正确答案：B。由肋胸膜与膈胸膜反折形成

解析：肋隔隐窝由肋胸膜与膈胸膜反折形成（B对A错）。当深吸气时，该间隙不能被肺填充（C错）。肋隔隐窝左、右各一（D错）。肋隔隐窝是胸膜腔位置最低的部位（E错）。